女，50岁，头痛呕吐2周，发作性抽搐3次，5年前行右乳腺癌根治术，头颅ct示：左额大片低密度影，占位明显，首先考虑诊断
A. 脑炎
B. 脑膜痛
C. 脑膜炎
D. 脑梗死
E. 转移性脑瘤

正确答案：E。转移性脑瘤

解析：患者女，50岁，头痛呕吐2周，发作性抽搐（脑转移瘤的表现）3次，5年前行右乳腺癌（乳腺癌是脑转移瘤最常见的原发肿瘤类型）根治术，头颅ct示：左额大片低密度影，占位明显（脑转移瘤的CT表现），结合患者的病史，表现和辅助检查，诊断为转移性脑瘤（E对C错）。B选项在外科学9版教材未明确说明。（P103）脑膜刺激征包括颈强直、 Kerning 征、 Brudzinski征等 ，见于脑膜炎、蛛网膜下腔出血、脑炎及颅内压增高等，深昏迷时脑膜刺激征消失（A错）。（P194-195）脑梗死又称缺血性脑卒中 ，是指各种脑血管病变所致脑部血液供应障碍，导致局部脑组织缺血、缺氧性坏死，而迅速出现相应神经功能缺损的一类临床综合征（D错）。以上四种疾病未出现发作性抽搐等表现，故除外。